根据《医疗机构药事管理规定》，药事管理与药物治疗学委员会的职责包括
A. 确定本医疗机构的用药目录和处方集
B. 执行本医疗机构的药品成本核算和账务管理制度
C. 统一采购供应本医疗机构临床使用的药品
D. 组织专家评估本医疗机构所用药物的临床疗效与安全性
E. 指导本医疗机构临床各科室合理用药

正确答案：A、D、E。确定本医疗机构的用药目录和处方集；组织专家评估本医疗机构所用药物的临床疗效与安全性；指导本医疗机构临床各科室合理用药

解析：本题考查的是药事管理与药物治疗学委员会的管理职责。根据《医疗机构药事管理规定》，药事管理与药物治疗学委员会的职责包括确定本医疗机构的用药目录和处方集（A对）、组织专家评估本医疗机构所用药物的临床疗效与安全性（D对）、指导本医疗机构临床各科室合理用药（E对）。药事管理与药物治疗学委员会的管理职责：药事管理与药物治疗学委员会（组）的职责包括：①贯彻执行医疗卫生及药事管理等有关法律、法规、规章。审核制定本医疗机构药事管理和药学工作规章制度，并监督实施；②制定本医疗机构药品处方集和基本用药供应目录；③推动药物治疗相关临床诊疗指南和药物临床应用指导原则的制定与实施，监测、评估本医疗机构药物使用情况，提出干预和改进措施，指导临床合理用药；④分析、评估用药风险和药品不良反应、药品损害事件，并提供咨询与指导；⑤建立药品遴选制度，审核本临床科室申请的新购入药品、调整药品品种或者供应企业和申报医院制剂等事宜；⑥监督、指导麻醉药品、精神药品、医疗用毒性药品及放射性药品的临床使用与规范化管理；⑦对医务人员进行有关药事管理法律法规、规章制度和合理用药知识教育培训；⑧向公众宣传安全用药知识等。医疗机构应当制订本医疗机构药品采购工作流程；建立健全药品成本核算和账务管理制度（B错）。医疗机构临床使用的药品应当由药学部门统一采购供应（C错）。经药事管理与药物治疗学委员会（组）审核同意，核医学科可以购用、调剂本专业所需的放射性药品。其他科室或者部门不得从事药品的采购、调剂活动，不得在临床使用非药学部门采购供应的药品。因临床急需进口少量药品的，应当按照《药品管理法》及其实施条例的有关规定办理。